有关氢氧化钙制剂的说法不正确的是
A. 具有强碱性
B. 具有抗炎抗菌性能
C. 促进修复性牙本质形成
D. 利于牙髓功能的恢复
E. 不溶于唾液，溶解度是垫底材料中最小的

正确答案：E。不溶于唾液，溶解度是垫底材料中最小的

解析：本题考查氢氧化钙制剂。氢氧化钙溶解性能较大，当边缘出现泄露易发生溶解（E错，为本题的正确答案）。氢氧化钙为碱性（A对），可中和炎症所产生的酸性产物，有利于消除炎症和减轻疼痛（B对），氢氧化钙在形成牙本质桥的过程中还可作为一种诱导剂，激活成牙本质细胞碱性磷酸酶而促进硬组织的形成。牙髓组织中未分化的间充质细胞在氢氧化钙诱导下，分化为成牙本质细胞，分泌牙本质基质，钙化后形成修复性牙本质（C对）。牙髓的功能为形成牙本质，氢氧化钙促进牙髓形成牙本质的功能（D对）。